可干扰转录过程和阻止RNA合成的抗肿瘤药物是
A. 顺铂
B. 塞替派
C. 丝裂霉素
D. 多柔比星
E. 长春瑞滨

正确答案：D。多柔比星

解析：本题考查抗肿瘤药物。可干扰转录过程和阻止RNA合成的抗肿瘤药物是多柔比星（D对）。多柔比星是直接抑制DNA合成的蒽醌药物，作用机制为分子嵌入到DNA的双链中形成稳定的复合物，影响DNA的功能，阻止DNA的复制和RNA的转录。顺铂（A错）的作用机制是破坏两条核苷酸链之间的氢键，扰乱DNA双螺旋结构，使肿瘤细胞DNA复制停止，阻碍细胞分裂。塞替派（B错）是破坏DNA的烷化剂，通过与细胞中DNA发生共价结合，使其丧失活性或使DNA分子发生断裂，导致肿瘤细胞死亡。丝裂霉素（C错）为破坏DNA的抗生素，丝裂霉素在体内酶作用下经过氧化还原反应，生成烷化剂，与DNA的鸟嘌呤和胞嘧啶碱基结合，抑制DNA的合成和功能。长春瑞滨（E错）属于长春碱类抗肿瘤药，属于长春碱类干扰有丝分裂的药物。